肾病综合症
A. 水肿、血尿、高血压
B. 发作性肉眼血尿、无水肿及高血压
C. 水肿、蛋白尿、高脂血症、低白蛋白血症
D. 水肿、蛋白尿、血尿、高血压、低蛋白血症
E. 蛋白尿、血尿、高血压、肾功能损害

正确答案：C。水肿、蛋白尿、高脂血症、低白蛋白血症